含有环状丙二酰脲结构，属国家特殊管理的精神药品是
A. 苯巴比妥
B. 苯妥英钠
C. 加巴喷丁
D. 卡马西平
E. 丙戊酸钠

正确答案：A。苯巴比妥

解析：本题考查巴比妥类药物。含有环状丙二酰脲结构，属国家特殊管理的精神药品是苯巴比妥（A对）。苯巴比妥为巴比妥类镇静催眠药，被列为第二类精神药品管控。苯妥英钠（B错）为乙内酰脲的5位两个氢被苯基取代后所得，对大脑皮层运动区有高度选择性抑制作用，一般认为是通过稳定脑细胞膜的功能及增加脑内抑制性神经递质5-羟色胺（5-HT）和γ-氨基丁酸（GABA）的作用，来防止异常放电的传播而具有抗癫痫的作用。加巴喷丁（C错）为抗癫痫药，含有γ-氨基丁酸结构，是口服吸收良好的药物。卡马西平（D错）属于二苯并氮䓬类药物，是该类药物中第一个上市的。丙戊酸钠（E错）含饱和碳原子，为广谱的抗癫痫药，对各种类型的癫痫都有一定疗效。